患儿，男，3岁。麻疹见疹已6日，高热不退，咳嗽气急，鼻翼煽动，口渴烦躁，舌红苔黄，脉数。其证型是
A. 顺证，见形期
B. 顺证，初热期
C. 逆证，热毒攻喉
D. 逆证，麻毒闭肺
E. 逆证，邪陷心肝

正确答案：D。逆证，麻毒闭肺

解析：麻毒炽盛，郁闭于肺，故高热不退，咳嗽气急，鼻翼煽动；麻毒火邪，燔灼肺胃，故口渴烦躁；舌红苔黄，脉数为肺有实热之象。提示逆证之麻毒闭肺证（D对）。麻疹见形期（A错）临床以发热起伏如潮，疹随外出，咳嗽加剧，烦渴，大便干结为特征。麻疹初热期（B错）临床以发热恶风，鼻塞流涕，畏光流泪，发热2～3天在口腔颊部近臼齿处出现麻疹黏膜斑为特征。热毒攻喉（新教材表述为”麻毒攻喉“）（C错）临床以麻疹疾病过程中出现咽喉肿痛，声音嘶哑，甚则吸气困难为特征。邪陷心肝（E错）临床以麻疹疾病过程中出现高热，烦躁谵妄，甚则神昏，抽搐为特征。